雷尼替丁治疗十二指肠溃疡的作用机制是
A. 中和胃酸
B. 直接抑制胃蛋白酶活性
C. 阻断胃腺细胞的H₂受体，抑制胃酸分泌
D. 形成保护膜，覆盖溃疡面
E. 加速胃蛋白酶的分解

正确答案：C。阻断胃腺细胞的H₂受体，抑制胃酸分泌